菌体细长略弯，末端膨大呈棒状，常分散排列成“V”或“L”形的是
A. 铜绿假单胞菌
B. 嗜肺军团菌
C. 白喉棒状杆菌
D. 幽门螺杆菌
E. 百日咳鲍特菌

正确答案：C。白喉棒状杆菌

解析：白喉棒状杆菌的菌体细长略弯，末端膨大呈棒状，常分散排列成“V”或“L”形，无菌毛、鞭毛和荚膜，不形成芽孢。掌握“军团菌、铜绿假单胞菌及白喉棒状杆菌”知识点。